下列关于某食物中毒的发病特点叙述正确的是
A. 发病与某种食物有关
B. 发病曲线呈缓慢上升趋势
C. 人与人之间有传染性
D. 临床症状完全不同
E. 潜伏期较长

正确答案：A。发病与某种食物有关

解析：食物中毒一般发病与某种食物有关（A对）。虽然食物中毒的原因不同、症状各异，但通常有共同发病特征：①潜伏期短（E错），发病突然，呈爆发性：②中毒患者有类似的临床表现（D错）：③发病均与某种食物有明确的关系（A对）：④患者对健康人无传染性（C错），停止食用有毒食物，发病很快停止。发病曲线呈突然上升、又迅速下降的趋势（B错）无传染病流行时的余波：⑤从中毒食物和中毒患者的生物样品中能检出与引起中毒临床表现一致的病原。